下列传入路径不经小脑下脚(绳状体)的有
A. 前庭小脑束
B. 脊髓小脑后束
C. 橄榄小脑束
D. 脊髓小脑前束
E. 楔小脑束

正确答案：D。脊髓小脑前束

解析：前庭小脑束、脊髓小脑后束、橄榄小脑束、楔小脑束均有经过小脑下脚，只有脊髓小脑前束（D错，为本题正确选项）在脑桥上部经小脑上脚及前髓帆进入小脑。